一中年男性，体胖，有高血压、高脂血症病史，近来有心前区疼痛出现。心绞痛可以有放射痛，常放射至何处
A. 肩、左臂内侧
B. 剑突下
C. 右肩、右臂内侧
D. 背部
E. 整个心前区

正确答案：A。肩、左臂内侧